早期确诊甲状腺功能减低症的实验室检查是
A. 甲状腺抗体的测定
B. TRH兴奋实验
C. 血清T₃、T₄、TSH测定
D. 甲状腺扫描
E. 骨龄测定

正确答案：C。血清T₃、T₄、TSH测定

解析：新生儿甲状腺功能减低症筛查需检测血清T4、TSH确诊，任何新生儿筛查结果可疑或临床可疑的小儿都应检测血清T4、TSH浓度，如T4降低、TSH明显升高即可确诊。早期甲状腺功能减低症需检测血清T4、TSH进行确诊（C对）。甲状腺抗体的测定、TRH兴奋实验、甲状腺扫描、骨龄测定均可佐证甲状腺功能的减低但不能作为早期确诊的检查（ABDE错）。